《突发公共卫生事件应急条例》规定，医疗卫生机构应对传染病做到
A. 早发现，早观察，早治疗，早康复
B. 早报告，早观察，早治疗，早康复
C. 早发现，早报告，早隔离，早治疗
D. 早发现，早报告，早隔离，早康复
E. 早预防，早发现，早治疗，早康复

正确答案：C。早发现，早报告，早隔离，早治疗

解析：医疗卫生机构应当对传染病做到早发现，早报告，早隔离，早治疗（C对），切断传播途径，防止扩散。突发卫生事件难以预防，第一步是早发现；观察延误时机有可能导致暴发流行，第二步应为早报告；突发卫生事件往往是传染性疾病，需要隔离，第三步早隔离；隔离后不能等待自愈，需要及时治疗，第四步早治疗。